卵巢内侧邻
A. 结肠
B. 子宫
C. 小肠
D. 直肠
E. 阴道

正确答案：C。小肠

解析：卵巢内侧邻小肠（C对）。子宫位于小骨盆中央，在膀胱与直肠（D错）之间；下端接阴道（E错）。